下列何病是规定报告的甲类法定传染病之一
A. 鼠疫
B. 登革热
C. 出血病
D. 狂犬病
E. 炭疽

正确答案：A。鼠疫

解析：本题考查法定甲类传染病。我国规定的法定甲类传染病为鼠疫（A对）和霍乱。登革热（B错）、出血热（C错）、狂犬病（D错）、炭疽（E错）均属于乙类传染病。